易导致肾气不固的情志异常是
A. 悲伤过度
B. 愤怒过度
C. 突然受惊
D. 喜乐过度
E. 恐惧过度

正确答案：E。恐惧过度

解析：情志活动分别由五脏所司，心在志为喜，肝在志为怒，脾在志为思，肺在志为忧，肾在志为恐；而情志过激，又反伤五脏精气，如怒伤肝（B错），喜伤心（D错），思伤脾，忧伤肺（A错），恐伤肾；肾居于下，其气主升，肾伤则肾气不固（E对）。另外《素问·举痛论》说：“惊则气乱”（C错）。